已有牙髓炎症状的隐裂牙以下治疗程序正确的是
A. 带环保护-根管治疗同时大量调磨牙尖-全冠修复
B. 带环保护-根管治疗-复合树脂黏合
C. 根管治疗-复合树脂黏合
D. 根管治疗后带环保护
E. 以上都不对

正确答案：A。带环保护-根管治疗同时大量调磨牙尖-全冠修复

解析：本题考查牙隐裂的防治原则。已有牙髓炎症状的隐裂牙以下治疗程序正确的是带环保护-根管治疗同时大量调磨牙尖-全冠修复（A对）。牙隐裂是指牙冠表面出现细小的、不易发现的、非生理性的细小裂纹，会使牙体组织抗力降低。对已有牙髓炎症状的隐裂牙进行根管治疗是必须的，但对牙体组织的磨切会使牙体硬组织进一步被削弱，造成裂线加深，在根管治疗时应进行带环保护（D错），以防止治疗过程中裂线加深，并大量调磨牙尖降低咬合以减轻（牙合）力负担，治疗完成后及时冠修复，以防止牙齿折裂（A对BCE错）。